球蛋白的浓度为
A. 1～10g/L
B. 10～20g/L
C. 15～30g/L
D. 20～40g/L
E. 25～45g/L

正确答案：C。15～30g/L

解析：球蛋白的浓度为15～30g/L。掌握“血液成分及血浆蛋白”知识点。